患者，男，24岁。头痛，以前额为主，阵阵发作，每遇风吹、受寒时疼痛加重，痛如锥剌，舌苔薄白，脉弦。治疗应首选
A. 上星、头维、合谷、阿是穴
B. 百会、通天、太冲、阿是穴
C. 神庭、百会、风池、阿是穴
D. 头临泣、率谷、风池、阿是穴
E. 上星、前顶、风池、阿是穴

正确答案：A。上星、头维、合谷、阿是穴

解析：本题考查常见的病症的辩证、处方。题中患者主诉头痛，故诊断为头痛，以前额为主，阵阵发作，每遇风吹、受寒时疼痛加重，痛如锥剌，舌苔薄白，脉弦，为阳明头痛（前额痛）。治以疏调经脉，通络止痛。按部位局部选穴和远端循经选穴为上星、头维、合谷、阿是穴（A对）。百会、通天、太冲、阿是穴用于治疗巅顶头痛（厥阴头痛）（B错）。神庭可用于治疗头痛、目眩、目赤、目翳等头面五官病症，百会、风池、阿是穴用于治疗内伤头痛（C错）。头临泣、率谷用于治疗侧头痛（少阳头痛），风池用于治疗外感头痛（D错）。上星为治疗阳明头痛，前顶用于治疗巅顶头痛（厥阴头痛）（E错）。